一般说来，下列哪项不是糖皮质激素的禁忌证
A. 急性粟粒性肺结核
B. 糖尿病
C. 水痘
D. 活动性消化性溃疡病
E. 孕妇

正确答案：A。急性粟粒性肺结核